要判断肺结核有无传染性，以下最可靠的依据是
A. PPD试验呈阳性反应
B. 痰中找到结核杆菌
C. 红细胞沉降率增快
D. X线胸片可见钙化点和空洞
E. 有发热、乏力等结核中毒症状

正确答案：B。痰中找到结核杆菌